抗流感病毒药奥司他韦作用机制是
A. 抑制RNA聚合酶
B. 阻滞离子通道M2
C. 抑制血凝素
D. 抑制神经氨酸酶
E. 激活神经氨酸酶

正确答案：D。抑制神经氨酸酶

解析：神经氨酸酶抑制剂 阻止病毒由被感染细胞释放和入侵邻近细胞，诚少病毒的播散及在体内的复制，对甲、乙型流感病毒均有作用。此类品种目前有奥司他韦（oseltamivir）、扎那米韦（zanamivir）、帕拉米韦第十版传染病学（Peramivir）及那尼纳米韦（Laninamivir）等（D对）。